急性心肌梗死时不宜溶栓治疗的情况是指同时伴有
A. 血压160/100mmHg
B. 6个月前腔隙性脑梗塞
C. 主动脉夹层
D. 2周前曾行桡动脉穿刺
E. 萎缩性胃炎1年

正确答案：C。主动脉夹层

解析：无条件施行介入治疗或因患者就诊延误、转送患者到可施行介入治疗的单位将会错过再灌注时机，如无禁忌症应立即（接诊患者后30分钟内）行本法治疗。其禁忌症包括未排除主动脉夹层（C对）、入院时严重且未控制的高血压（＞180/100mmHg）（A错）、6个月内发生过缺血性脑卒中或脑血管事件（B错）、近期（＜2周）曾有在不能压迫部位的大血管行穿刺术（D错）等。萎缩性胃炎（E错）为常见消化道疾病，可见于大多数人，并非溶栓治疗禁忌症。